患者潮热，腹痛拒按，便秘，口干唇裂，舌苔焦燥，脉沉数有力。其证型是
A. 阳明热盛
B. 热郁胸膈
C. 热灼营阴
D. 热郁胆腑
E. 阳明热结

正确答案：E。阳明热结

解析：阳明经气旺于日晡，实热弥漫于经，邪正相争更剧，故潮热日晡尤甚；邪热与糟粕结于肠中，腑气不通，故腹痛拒按，便秘；邪热内结而津液被劫，故口干唇裂，舌苔焦燥；邪热亢盛，有形之邪阻滞，脉道壅滞，故脉沉数有力，故其证候为阳明热结证（即阳明腑实证）（E对）。阳明热盛证（A错），即阳明经证，其证候表现为身大热，汗出，口渴引饮，或心烦躁扰，气粗似喘，面赤，苔黄燥，脉洪大。热郁胸膈（B错）证候表现为身热不甚，心烦懊，坐卧不安，欲呕不得呕，舌红苔黄，脉滑数。热灼营阴（C错）证候表现为身热夜甚，心烦躁扰，舌质红降而干，苔薄或无苔，脉细数。热郁胆腑（D错）证候表现为身热，口苦而渴，干呕，心烦，小便短赤，舌红苔黄，脉象弦数。